第6颈髓平对
A. 腰神经根
B. 第4颈椎
C. 第5颈椎
D. 第6颈椎
E. 第7颈椎

正确答案：C。第5颈椎

解析：根据不同部位脊髓与脊椎骨的位置对应关系，第6颈髓平对第5颈椎（C对）。